“无阴则阳无以生，无阳则阴无以化”体现了阴阳之间的哪种关系
A. 阴阳对立
B. 阴阳互根
C. 阴阳制约
D. 阴阳转化
E. 阴阳平衡

正确答案：B。阴阳互根

解析：“无阴则阳无以生，无阳则阴无以化”是指阴是阳的生化之源，阳是阴的生成之力体现了阴阳互根互用的关系（B对）。阴阳对立，指阴阳“一分为二”，即对待、相反的关系，是事物或现象固有的属性（A错）。阴阳相互制约是指阴阳之间相互牵制、约束（C错）。阴阳转化，指事物的阴阳属性，在一定条件下可以向其相反的方向转化（D错）。阴阳消长，指阴阳双方不是静止不变的，而是处于不断的消减和增加的运动变化之中（E错）。